治疗石淋，应首选
A. 程氏萆薢分清饮
B. 无比山药丸
C. 八正散
D. 沉香散
E. 石韦散

正确答案：E。石韦散

解析：程氏萆薢分清饮功能清利湿热，分清泄浊，为膏淋实证的选方（A错）。无比山药丸功能健脾益肾，为劳淋的选方（B错）。八正散功能清热解毒，利湿通淋，为热淋的选方（C错）。沉香散功能疏肝达气，活血行水，为气淋实证的选方（D错）。石淋为湿热蕴结下焦，尿液煎熬成石，膀胱气化失司所致，治宜清利湿热，排石通淋，首选石韦散加减（E对）。